关于地方性氟中毒，错误的是
A. 地方性氟中毒的病因目前尚不清楚
B. 目前尚无针对地方性氟中毒的特效治疗方法
C. 氟骨症分为硬化型、疏松型、软化型和混合型
D. 本病的根本预防措施是减少氟的摄入量
E. 地方性氟中毒非骨相损害中以神经系统损害多见

正确答案：A。地方性氟中毒的病因目前尚不清楚

解析：本题考查地方性氟中毒。地方性氟中毒是由于一定地区的环境中氟元素过多，而致生活在该环境中的居民经饮水、食物和空气等途径长期摄入过量氟（A错，为本题正确答案）所引起的一种慢性全身性疾病。其临床表现有氟斑牙、氟骨症、非骨相氟中毒。氟骨症分为硬化型、疏松型、软化型和混合型（C对）。地方性氟中毒非骨相损害中以神经系统损害多见（E对），另外有骨骼肌、肾脏等的损害。地方性氟中毒的根本预防措施是减少氟的摄入量（D对），目前尚无针对本病的特效治疗方法（B对）。